门静脉高压症的主要原因是
A. 门静脉主干先天性畸形
B. 肝静脉血栓形成、狭窄
C. 肝段下腔静脉阻塞
D. 肝硬化
E. 各种原因致脾静脉血流量过大

正确答案：D。肝硬化

解析：门脉高压症分为肝内型（95%）和肝外型（5%）。肝内型门脉高压症又分为窦前行、窦后型、窦型。我国肝炎发病率高，肝炎后肝硬化（D对）是引起肝窦和窦后阻塞性门静脉高压症的最常见原因。门静脉主干先天性畸形（A错）可导致肝前型门脉高压，肝静脉血栓形成、狭窄（B错）和肝段下腔静脉阻塞（C错）可导致肝后型门脉高压。二者均属肝外型门脉高压，不常见。各种原因致脾静脉血流量过大（E错）可通过开放肝脏内部动静脉小交通支平衡血液压力，对门脉压力影响较小。